对于接受胰岛素治疗的患者，可判断其胰岛功能的指标是
A. 糖化血红蛋白
B. 血糖
C. 糖化血浆白蛋白
D. C肽
E. 胰岛素

正确答案：D。C肽

解析：对于接受胰岛素治疗的患者，可判断其胰岛功能的指标是C肽（D对）。